女，54岁。肝硬化20年。腹部B超检查：腹水最大液深18cm。化验检查：血清钠142mmol/L，钾6.3mmol/L，BUN23mmol/L，血肌酐224umol/L。治疗措施错误的是
A. 10%葡萄糖酸钙20ml缓慢静脉注射
B. 口服螺内酯
C. 输白蛋白
D. 控制体液入量
E. 葡萄糖加胰岛素静点

正确答案：B。口服螺内酯

解析：本例患者为肝硬化伴腹水，血清钾6.3mmol/L（正常值3.5～5.5mmol/L，提示有高钾血症）。对肝硬化腹水的治疗应在控制体液入量（D对）的前提下使用利尿剂治疗，一般联合使用保钾及排钾利尿剂。螺内酯为保钾利尿剂，单纯口服螺内酯（B错，为本题正确答案）会加重患者的高钾血症。在利尿效果不满意时，可酌情输白蛋白（C对），有利于减轻腹水。高血钾对心脏有抑制作用，10％葡萄糖酸钙20ml缓慢静脉注射（A对）可对抗钾的心肌毒性。葡萄糖加胰岛素静点（E对）可使血清钾转移至细胞内以降低血清钾。